治疗肝郁气滞证，久疟痞块，应首选的药物是
A. 陈皮
B. 木香
C. 枳实
D. 青皮
E. 乌药

正确答案：D。青皮

解析：本题主要考察理气药的功效、应用。青皮疏肝破气，消积化滞，可用于肝郁气滞证；气滞脘腹疼痛；食积腹痛；癓瘕积聚，久疟痞块（D对）。陈皮理气健脾，燥湿化痰。可用于脾胃气滞证；呕吐、呃逆；湿痰、寒痰咳嗽；胸痹（A错）。木香行气止痛，健脾消食。可用于脾胃气滞证；泻痢里急后重；腹痛胁痛，黄疸、疝气疼痛；胸痹（B错）。枳实破气消积，化痰除痞，可用于胃肠积滞，湿热泻痢；胸痹，结胸；气滞胸胁疼痛4.产后腹痛（C错）。乌药行气止痛，温肾散寒，可用于寒凝气滞胸腹诸痛证；尿频，遗尿（E错）。